可改善认知功能但有加重消化性溃疡风险的药物是
A. 劳拉西泮
B. 美金刚
C. 多塞平
D. 多奈哌齐
E. 左乙拉西坦

正确答案：D。多奈哌齐

解析：本题考查多奈哌齐。可改善认知功能但有加重消化性溃疡风险的药物是多奈哌齐（D对）。多奈哌齐为胆碱脂酶抑制剂，不良反应使腹泻、肌肉痉挛、乏力、恶心、失眠、心动过缓、低血压、头痛和消化性溃疡加重。劳拉西泮（A错）抗焦虑作用强，通常可在数分钟至数小时内缓解情绪症状和躯体症状，对急性期焦虑患者可考虑短期使用，一般治疗时间不超过2～3周。美金刚（B错）单药或与多奈哌齐合用对中至重度AD患者有一定疗效。多塞平（C错）为三环类抗抑郁药。左乙拉西坦（E错）为抗癫痫药，育龄期妇女酌情选用。